间质性肾炎患者出现蛋白尿的类型是
A. 肾小球性蛋白尿
B. 肾小管性蛋白尿
C. 溢出性蛋白尿
D. 组织性蛋白尿
E. 假性蛋白尿

正确答案：B。肾小管性蛋白尿

解析：急性间质性肾炎因其病因不同，临床表现各异，无特异性。主要突出表现为少尿性或非少尿性急性肾功能不全，可伴有疲乏无力、发热及关节痛等非特异性表现。肾小管功能损失可出现低比重及低渗透压尿、肾小管性蛋白尿及水、电解质和酸碱平衡紊乱，部分患者表现为Fanconi综合征（B对）。肾小球性蛋白尿是由于炎症等因素导致肾小球滤过膜受损以致孔径增大，或静电屏障作用减弱，血浆蛋白质特别是白蛋白大量进入肾小囊，超过肾小管重吸收的能力所形成的蛋白尿，称为肾小球性蛋白尿。见于原发性肾小球疾病如肾小球肾炎、肾病综合征和某些继发性肾小球疾病（如糖尿病、高血压、妊娠高血压综合征和SLE等）（A错）。溢出性蛋白尿其肾功能正常，但由于血循环中出现大量低分子量蛋白质如免疫球蛋白轻链、游离血红蛋白或肌红蛋白等，可经肾小球滤出，超过肾小管重吸收能力所致的蛋白尿。见于多发性骨髓瘤、巨球蛋白血症、大面积心肌梗死、严重骨骼肌创伤和急性血管内溶血等（C错）。组织性蛋白尿：肾组织破坏或肾小管分泌蛋白增多所致的蛋白尿，多为低分子量蛋白尿。见于肾盂肾炎、膀胱癌等（D错）。假性蛋白尿又称偶然性蛋白尿，肾脏以下泌尿道疾病导致大量脓、血、黏液等混入尿中，或阴道分泌物掺入尿中，均可引起蛋白定性试验阳性。常见于泌尿系统感染等（E错）。